现测得15名正常人、13名急性病毒性心肌炎患者和12名原发性扩张型心肌病患者的白细胞介素，其均数分别为：0.203、2.738和2.844。欲判断上述三类人群白细胞介素均数是否不同，宜选择
A. 经χ²检验后才能确定
B. 先作完全随机设计的方差分析，再作q检验才能确定
C. 作配伍组设计的方差分析，再作q检验才能确定
D. 需分别作两类患者与正常人的t检验才能确定
E. 需分别作两类患者与正常人的q检验才能确定

正确答案：B。先作完全随机设计的方差分析，再作q检验才能确定